有关腹壁的淋巴结的描述，错误的是
A. 脐平面以上的腹前壁的淋巴管一般注入腋淋巴结
B. 脐平面以下的腹前壁的浅淋巴管一般注人腹股沟浅淋巴结
C. 腹后壁的淋巴管注入腰淋巴结
D. 以上均不正确
E. 无

正确答案：D。以上均不正确

解析：脐平面以上的腹前壁淋巴管注入一般腋淋巴结（A对），脐平面以下腹前壁浅淋巴管注入腹股沟浅淋巴结（B对），腹后壁和腹腔成对脏器淋巴管注入腰淋巴结（C对，D为本题正确答案）